对放射治疗最敏感的卵巢恶性肿瘤是
A. 未成熟型畸胎瘤
B. 浆液性囊腺癌
C. 颗粒细胞瘤
D. 无性细胞瘤
E. 黏液性囊腺癌

正确答案：D。无性细胞瘤

解析：对放射治疗最敏感的卵巢恶性肿瘤是无性细胞瘤（D对）。无性细胞瘤为中度恶性的实性肿瘤，属于卵巢生殖细胞肿瘤。对放疗敏感，但放疗会破坏患者卵巢功能，常造成患者生育功能的丧失，现已极少应用，仅用于治疗复发的无性细胞瘤。未成熟型畸胎瘤（A错）同属于卵巢生殖细胞肿瘤、浆液性囊腺癌（B错）和黏液性囊腺癌（E错）属于卵巢上皮性肿瘤、颗粒细胞瘤（C错）属于卵巢性索间质肿瘤，通常采用手术治疗，可辅以放化疗。